不发生于颈侧区的疾病是
A. 胸腺咽管嚢肿
B. 囊状淋巴管瘤
C. 颈动脉瘤
D. 血管瘤
E. 甲状舌管囊肿

正确答案：E。甲状舌管囊肿

解析：胚胎期，甲状腺是由口底向颈部伸展的甲状腺舌管下端发生的，若发育中甲状舌管退化不全，可形成先天性囊肿，表现为颈前正中区、舌骨下方有直径1～2cm的圆形肿块（E错，为本题正确答案）。胸腺咽管嚢肿（A对）为胸腺咽管退化不全形成的囊肿，为位于颈侧部、胸锁乳突肌前方或后方的球形、无痛性肿物。囊状淋巴管瘤（B对）又称囊状水瘤，是原始淋巴管发育增生形成的肿物，多数发生于胸锁乳突肌后缘的锁骨上窝处，颈后三角为好发部位，左侧多于右侧。颈动脉瘤（C对）好发于颈动脉分叉处，亦可位于颈内及颈总动脉，位于颈侧区。颈部血管瘤（D对），由大量增生的血管所构成，多位于颈侧区。